女童，8岁，前牙外伤1周后就诊。右上中切牙冠折2/3，近中达龈下1mm，露髓处探诊不疼痛，叩诊（+），出血暗红，Ⅰ度松动。X线片未见根折，根尖呈喇叭口型。处理方法选择
A. 氢氧化钙活髓切断术
B. 甲醛甲酚活髓切断术
C. 根尖诱导成形术
D. 根管治疗术
E. 拔除

正确答案：C。根尖诱导成形术

解析：本题考查根尖诱导成形术的应用。女童8岁，前牙（年轻恒牙）外伤1周后就诊。右上中切牙冠折2/3（冠折近髓），近中达龈下1mm，露髓处探诊不疼痛，叩诊（+），出血暗红（牙髓感染），Ⅰ度松动。X线片未见根折，根尖呈喇叭口型（牙根未发育完全），综合考虑，处理方法选择根尖诱导成形术（C对）。根尖诱导成形术（apexification）是指牙根未完全形成之前发生牙髓严重病变或根尖周炎症的年轻恒牙，在控制感染的基础上，用药物及手术方法保存根尖部的牙髓或使根尖周组织沉积硬组织，促使牙根继续发育和根尖形成的治疗方法。因为患牙是年轻恒牙，牙根未发育完全，应尽量保守治疗，让其牙根继续发育，不应行根管治疗术（D错）和拔除（E错）。露髓处探诊不疼痛，应尽量保留冠髓，不行氢氧化钙活髓切断术（A错）和甲醛甲酚活髓切断术（B错）。并且年轻恒牙是禁止用甲醛甲酚类药物的。